男，18岁，近一年来对家人亲友变得冷淡，不去上学，不洗澡，不主动更换衣服，对与自己有关的各种事情表现得无动于衷。最可能的诊断是
A. 人格障碍
B. 精神分裂症
C. 抑郁症
D. 恐怖症
E. 创伤后应激障碍

正确答案：B。精神分裂症

解析：该病例患者近一年，以对家人亲友冷淡（社会退缩），不上学、生活上懒于自理（意志减退）为主要表现，意志减退和社会退缩为精神分裂症的阴性症状，故最可能的诊断是精神分裂症（B对）。人格障碍是一个固定的情绪、行为模式，但还是一个量的变化，一般无明显的精神病性症状（A错）。抑郁症以显著而持久的情感低落（忧愁、苦闷、唉声叹气、暗自落泪）为主要表现，本例无此症状，故不考虑（C错）。创伤后应激障碍的患者在强烈的创伤性事件后数天至半年内发病，反复重现创伤性体验（频频出现与创伤性事件有关的梦境），本例无明显精神刺激因素（天灾人祸），无此症状，故不考虑（E错）。